诊断缺铁性贫血铁减少期的敏感指标是
A. 血清铁蛋白
B. 血红蛋白
C. 红细胞游离原卟啉
D. 转铁蛋白饱和度
E. 血清铁

正确答案：A。血清铁蛋白

解析：缺铁性贫血分为铁减少期（ID）、缺铁性红细胞生成期（IDE）、缺铁性贫血期（IDA）。铁减少期主要表现为贮存铁（血清铁蛋白、含铁血黄素）减少，血红蛋白（B错）和血清铁（E错）尚正常，故血清铁蛋白（A对）是诊断缺铁性贫血铁减少期的敏感指标。红细胞游离原卟啉（C错）升高和转铁蛋白饱和度（D错）降低常出现在缺铁性红细胞生成期（IDE）以后，铁减少期尚无改变。